血压持续在160/95mmHg以上，眼底动脉普遍狭窄，属于
A. 高血压病1级
B. 高血压病2级
C. 高血压病3级
D. 高血压危象
E. 高血压脑病

正确答案：B。高血压病2级

解析：血压持续在160/95mmHg以上，眼底动脉普遍狭窄，属于高血压病2级（B对）。当收缩压和舒张压处于不同的高血压分级时，按照等级高的来判别。高血压病1级（A错）收缩压140～159mmHg和（或）舒张压90～99mmHg。高血压病3级（C错）收缩压≥180mmHg和（或）舒张压≥110mmHg。高血压危象（D错）包括高血压急症及亚急症。病情急剧恶化，同时伴有进行性心、脑、肾、视网膜等重要的靶器官功能不全的表现。高血压脑病（E错）是指当血压突然升高超过脑血流自动调节的阈值（中心动脉压大于140mmHg）时，脑血流出现高灌注，毛细血管压力过高，渗透性增强，导致脑水肿和颅内压增高，甚至脑疝的形成，引起的一系列暂时性脑循环功能障碍的临床表现。